青春期
A. 月经未来潮
B. 第二性征未发育
C. 是儿童期末到性成熟期之间的一段时期
D. 生殖器官未发育
E. 易发生外阴阴道炎

正确答案：C。是儿童期末到性成熟期之间的一段时期

解析：本题考查青春期的相关内容。青春期是儿童期末到性成熟期之间的一段时期（C对），青春期的生理发育特点：第二性征发育（B错）、生殖器官（D错）即第一性征发育，出现生长突增、月经来潮（A错）、初步具有生殖能力等，女童期（E错）易发生外阴阴道炎。